中毒性脑病的脑脊液改变
A. 白细胞数5×10⁶/L，淋巴细胞为主，蛋白0.3g/L，糖3.5mmol/L
B. 白细胞数50×10⁶/L，淋巴细胞为主，蛋白1.0g/L，糖1.5mmol/L
C. 白细胞数2000×10⁶/L，中性粒细胞为主，蛋白1.0g/L，糖3.5mmol/L
D. 白细胞数5×10⁶/L，淋巴细胞为主，蛋白0.8g/L，糖3.5mmol/L
E. 白细胞数5×10⁶/L，淋巴细胞为主，蛋白0.3g/L，糖2.5mmol/L

正确答案：A。白细胞数5×10⁶/L，淋巴细胞为主，蛋白0.3g/L，糖3.5mmol/L

解析：急性中毒性脑病是婴幼儿时期比较常见的一种中枢神经系统病变，其主要临床表现是在原发病为中枢神经系统以外的疾病的过程中，突然出现中枢神经系统症状，临床表现类似脑炎，如出现意识障碍、昏睡或昏迷、抽搐和病理反射等，但脑脊液检查常无其他的异常发现（A对）。